行程于上纵隔和后纵隔的结构是
A. 气管
B. 食管
C. 上腔静脉
D. 膈神经
E. 胸主动脉

正确答案：B。食管

解析：食管（B对）走行于上纵隔和后纵隔。